药用部位为根和根茎的药材有
A. 细辛
B. 大黄
C. 当归
D. 甘草
E. 丹参

正确答案：A、B、D、E。细辛；大黄；甘草；丹参

解析：本题考查的是常用中药的药用部位。药用部位为根和根茎的药材有细辛（A对）、大黄（B对）、甘草（D对）、丹参（E对）。细辛：【来源】为马兜铃科植物北细辛、汉城细辛或华细辛的干燥根和根茎。大黄：【来源】为蓼科植物掌叶大黄、唐古特大黄或药用大黄的干燥根及根茎。甘草：【来源】为豆科植物甘草、胀果甘草或光果甘草的干燥根及根茎。丹参：【来源】为唇形科植物丹参的干燥根和根茎。当归（C错）：【来源】为伞形科植物当归的干燥根。